下列哪一种是用来防止传染病由国外传入的措施
A. 检疫
B. 消毒
C. 预防接种
D. 疾病监测
E. 卫生监督

正确答案：A。检疫

解析：本题考查防治传染病由国外输入的措施。检疫（A对BCDE错）是用来防止传染病由国外传入的措施。